不协调性子宫收缩乏力时，首选药物治疗应是
A. 硫酸镁静脉滴注
B. 哌替啶肌内注射
C. 肼苯哒嗪静脉滴注
D. 甘露醇快速静滴
E. 氯丙嗪静脉推注

正确答案：B。哌替啶肌内注射

解析：不协调性宫缩乏力的首选药物是哌替啶（B对）。主要是利用哌替啶等镇静剂使产妇充分休息，醒后不协调性宫缩多能恢复为协调性宫缩。硫酸镁（A错）解痉降压，主要用于子痫的治疗及重度子痫前期预防子痫发作的预防用药（P69）。肼苯哒嗪（C错）现多用于肾性高血压及舒张压较高的重度高血压病人。氯丙嗪静脉推注（E错）主要和哌替啶、异丙嗪组成冬眠合剂控制子痫抽搐（P70）。